关于呋塞米，哪一项是错误的
A. 抑制近曲小管的碳酸酐酶活性
B. 促使HCO3-出增加
C. 利尿作用机制是抑制髓袢升支髓质段的Na+、Cl-共同转运
D. 增加肾血流量
E. 改变肾皮质内血流分布

正确答案：C。利尿作用机制是抑制髓袢升支髓质段的Na+、Cl-共同转运

解析：大剂量呋塞米也可以抑制近曲小管的碳酸酐酶活性，使HCO3-出增加。袢利尿药通过对血管床的直接扩张作用影响血流动力学。对心力衰竭的病人，呋塞米和依他尼酸能迅速增加全身静脉血容量，降低左室充盈压，减轻肺淤血。呋塞米还能增加肾血流量，改变肾皮质内血流分布。掌握“袢利尿药及噻嗪类”知识点。